男，67岁，46缺失，牙槽嵴中度丰满，平整，余留牙正常，可摘局部义齿设计为47卡臂卡环，（牙合）支托窝应预备在
A. 颊沟
B. 中央窝
C. 舌沟
D. 远中（牙合）边缘嵴
E. 近中（牙合）边缘嵴

正确答案：E。近中（牙合）边缘嵴

解析：本题考查（牙合）支托。男，67岁，46缺失，牙槽嵴中度丰满，平整，余留牙正常，可摘局部义齿设计为47卡臂卡环，（牙合）支托窝应预备在近中（牙合）边缘嵴（E对）。若上、下颌牙咬合过紧，无法获得支托间隙，可将（牙合）支托设置在磨牙的颊、舌侧（AC错）。（牙合）支托不能设置在磨牙的（牙合）面中央窝（B错）。患者46缺失，若在缺隙近中的基牙上设置支托，则（牙合）支托窝应制备在基牙的远中（牙合）边缘嵴上（D错）；若在47上设置卡环，（牙合）支托窝应预备在47的近中（牙合）边缘嵴上。